患者，女性，38岁，风心病5年，超声心动图检查示二尖瓣中度狭窄。2个月前曾患感冒，当时发热1周。近1个月工作较劳累，经常出现夜间阵发性呼吸困难。目前体温正常，血、尿常规正常。此患者首先应考虑的诊断是
A. 亚急性细菌性心内膜炎
B. 急性细菌性心内膜炎
C. 风心病合并左心衰
D. 风心病合并右心衰
E. 风心病合并肺部感染

正确答案：C。风心病合并左心衰

解析：患者风心病5年，经常出现阵发性呼吸困难，超声心动图检查示二尖瓣中度狭窄，考虑左心衰的可能性大。掌握“心力衰竭”知识点。